药物在体内经过药物代谢酶的催化作用，发生结构改变的过程称为
A. 诱导效应
B. 首过效应
C. 抑制效应
D. 肝肠循环
E. 生物转化

正确答案：E。生物转化

解析：本题考查生物转化。生物转化（E对）是药物在体内经过药物代谢酶的催化作用，发生结构改变的过程。药物的生物转化分为二相：第一相生物转化是指体内各种酶对药物分子进行的官能团化反应，主要发生在分子的官能团上；第Ⅱ相生物转化反应是指通过转移酶的催化，与药物或药物在第Ⅰ相的代谢产物结合，形成代谢结合物，被结合的基团通常是羟基、氨基、羧基、杂环氮原子等。诱导效应（A错）是指在有机化合物分子中，由于电负性不同的取代基（原子或原子团）的影响，使整个分子中的成键电子云密度向某一方向偏移，使分子发生极化的效应。首过效应（B错）是指某些药物经胃肠道给药，在尚未吸收进入血循环之前，在肠黏膜和肝脏被代谢，而使进入血循环的原形药量减少的现象。酶的抑制效应（C错）是指能抑制肝药酶活性，减慢其它药物的代谢速率。肠-肝循环（D错）：药物由肝脏代谢的代谢物或者是没有被代谢的原型，经过胆汁排入十二指肠，部分在小肠被重吸收，再经过肝门静脉流入肝，重新进入血液循环。